蘑菇山药胡萝卜芹菜，最适宜哪个季节食用
A. 冬季
B. 春季
C. 长夏之季
D. 秋季
E. 夏季

正确答案：A。冬季

解析：蘑菇性平味甘，具有补脾益气、润燥化痰、健胃平肝等作用，冬天食用蘑菇可以提高免疫力预防感冒；山药性甘平、无毒，具有补脾益肾、养肺等功效，多天适量的吃山药，可以起到润肺止咳的作用，预防一些呼吸系统的疾病；胡萝卜味甘、辛，性平，具有健脾和胃、滋肝明目、清热解毒、化痰止咳的作用，冬天食用胡萝卜可以提高机体的免疫力；芹菜性凉味甘、微苦，有平肝凉血和清热解毒的功效。冬天天气寒冷干燥，适当吃些芹菜有助于缓解口干舌燥、气喘心烦等症状（A对，BCDE错）。